中心静脉压的高低取决于下列哪项因素
A. 血管容量和血量
B. 动脉血压和静脉血压之差
C. 心脏射血能力和静脉回心血量
D. 心脏射血能力和外周阻力
E. 外周静脉压

正确答案：C。心脏射血能力和静脉回心血量